孕妇需用解热镇痛药时可选用
A. 对乙酰氨基酚
B. 阿司匹林
C. 吲哚美辛
D. 氢化可的松
E. 哌替啶

正确答案：A。对乙酰氨基酚

解析：本题考查药物妊娠毒性分级。孕妇需用解热镇痛药时可选用对乙酰氨基酚（A对）。对乙酰氨基酚有解热镇痛作用，在动物生殖试验中并未显示对胎儿的危险，属于妊娠用药B级药物，故孕妇可服。阿司匹林（B错）为C级药物。吲哚美辛（C错）为B级药物，妊娠晚期或临产前为D级药物。氢化可的松（D错）为糖皮质激素类药物，属于C级药物，妊娠早期用药为D级药物。哌替啶（E错）为镇痛药，属于B级药物，临近分娩欧长期大量用为D级药物。